乙琥胺
A. 可引起瞳孔扩大
B. 可引起呼吸抑制
C. 可引起共济失调
D. 可引起急性心力衰竭
E. 可引起再生障碍性贫血

正确答案：E。可引起再生障碍性贫血

解析：乙琥胺是常用的抗癫痫药，其作用机制与抑制T型Ca²⁺通道有关，是临床治疗小发作（失神性发作）的首选药，其毒性低常见的副反应为胃肠道反应，其次为中枢神经系统症状，偶见嗜酸性粒细胞缺乏症或粒细胞缺乏症，严重者发生再生障碍性贫血（E对）。可引起瞳孔扩大（A错）是阿托品的常见不良反应。可引起呼吸抑制（B错）是吗啡的常见不良反应。可引起共济失调（C错）是苯妥英钠的常见不良反应。可引起急性心力衰竭（D错）常见各种可以增加心脏负担的药物，均可以导致急性心力衰竭。